联合用药时，高效利尿药与何药合用可增加耳毒性
A. 解热镇痛药
B. 氨基苷类抗生素
C. 第一第二代头孢菌素
D. 青霉素
E. 强心苷

正确答案：B。氨基苷类抗生素

解析：高效利尿药如呋塞米的不良反应-耳毒性：呈剂量依赖性，表现为眩晕、耳鸣、听力下降或暂时性耳聋。肾功能减退或大剂量静脉注射时易发生，应避免与有耳毒性的氨基糖苷类抗生素合用（B对）。